一正常小儿身高80cm，前囟已闭，头围47cm，乳牙16枚，能用简单的语言表达自己的需要，对人、事有喜乐之分。按公式计算此小儿的体重约是
A. 15Kg
B. 13.5Kg
C. 12Kg
D. 10.5Kg
E. 9Kg

正确答案：D。10.5Kg

解析：一正常小儿身高80cm，前囟已闭，头围47cm，乳牙16枚，能用简单的语言表达自己的需要，对人、事有喜乐之分等提示该小儿年龄介于1～2岁之间，最可能为1岁半。而由表2～1可知，1～6岁年龄的儿童体重公式为年龄（岁）×2＋8，故该小儿体重约为11kg左右（D对）。